肾皮质形成的结构是
A. 肾盂
B. 肾锥体
C. 肾柱
D. 肾乳头
E. 乳头孔

正确答案：C。肾柱

解析：伸入肾锥体之间的肾皮质称肾柱（C对）。肾盂（A错）由肾大盏汇合而成。肾锥体（B错）是组成肾髓质的结构，2~3个肾锥体尖端合并成肾乳头（D错），肾乳头顶端有许多小孔称乳头孔（E错）。